既破血逐瘀，又杀虫的药是
A. 干漆
B. 血竭
C. 苏木
D. 虎杖
E. 自然铜

正确答案：A。干漆

解析：本题考查干漆的功效。既破血逐瘀，又杀虫的药是干漆（A对）。干漆【功效】破血祛瘀，杀虫。血竭（B错）【功效】活血定痛，化瘀止血，生肌敛疮。苏木（C错）【功效】活血祛瘀，消肿止痛。虎杖（D错）【功效】利湿退黄，清热解毒，活血祛瘀，化痰止咳，泻下通便。自然铜（E错）【功效】散瘀止痛，接骨疗伤。